高血压合并血脂异常患者的血压控制目标值应低于
A. 140/90mmHg
B. 140/80mmHg
C. 150/90mmHg
D. 130/80mmHg
E. 130/90mmHg

正确答案：D。130/80mmHg

解析：本题考查高血压合并血脂异常患者的血压控制目标。高血压合并血脂异常患者的血压控制目标值应低于130/80mmHg（D对）。140/90mmHg是目前一般主张血压控制目标值应该控制的范围（A错）。对于老年收缩期高血压患者，收缩压控制于150mmHg以下（C错），如果能够耐受可降至140mmHg以下。对于血脂异常患者合并高血压患者，血压控制目标值＜130/80mmHg。